体表最高摸到股动脉的部位是
A. 收肌管上方
B. 股外侧部
C. 股三角下部
D. 腹股沟中点稍下方
E. 腹股沟韧带外、中1/3交点处

正确答案：D。腹股沟中点稍下方

解析：腹股沟中点稍下方（D对）股动脉位置表浅，为体表最高摸到股动脉的部位。